对大多数慢性疾病可实行二级预防，这是指
A. 健康教育
B. 病因预防
C. 疾病管理
D. 早发现，早诊断，早治疗
E. 促进康复，防止疾病恶化

正确答案：D。早发现，早诊断，早治疗

解析：本题考查二级预防。对大多数慢性疾病可实行二级预防，这是指早发现，早诊断，早治疗（D对ABCE错）。大多数慢性病无法治愈，可以通过治疗阻止疾病发展到更严重的阶段或至少减缓发展进程，减少对更复杂的治疗措施的需要。